患者，男，48岁。患胃溃疡1年。胃脘灼热疼痛，胸胁胀满，泛酸，口苦口干，烦躁易怒，大便秘结，舌红，苔黄，脉弦数。其证型是
A. 肝胃郁热
B. 肝胃不和
C. 脾胃虚寒
D. 胃阴不足
E. 胃络瘀阻

正确答案：A。肝胃郁热

解析：肝气郁结，日久化热，邪热犯胃，故胃脘灼热疼痛，胸胁胀满；肝胃郁热，横逆上冲，故泛酸；肝热夹胆火上承则口苦口干，烦躁易怒；大便秘结，舌红，苔黄，脉弦数均为肝气犯胃，胃气阻滞，郁久化热而引起（A对）。肝胃不和（B错）的特点为胃脘胀痛，痛引两胁，因情志不遂而诱发或加重，嗳气，反酸，口苦。脾胃虚寒（C错）的特点为胃痛隐隐，喜温喜按，畏寒肢冷，泛吐清水，腹胀便溏，舌淡胖，边有齿痕，苔白，脉迟缓。胃阴不足（D错）的特点为胃脘隐痛，似饥而不欲食，口干而不欲饮，纳差，干呕，手足心热，大便干结。胃络瘀阻（E错）的特点为胃痛如刺，痛处固定，肢冷，汗出，有呕血或黑便，舌质紫暗，或有瘀斑，脉涩。